药学服务的具体工作包括
A. 处方审核
B. 处方调剂与核对
C. 参与临床药物治疗
D. 治疗药物监测
E. 药学信息服务与患者教育

正确答案：A、B、C、D、E。处方审核；处方调剂与核对；参与临床药物治疗；治疗药物监测；药学信息服务与患者教育

解析：本题考查药学服务的具体工作。药学服务的具体工作包括：处方审核（A对）、处方调剂与核对（B对）、参与临床药物治疗（C对）、治疗药物监测（D对）、药学信息服务与患者教育（E对）。